根据《医疗机构制剂注册管理办法》，提供虚假的证明文件、申报资料、样品或者采取其他欺骗手段申请批准证明文件的，己取得批准证明文件的，撤销其批准证明文件
A. 一年内不受理其申请，并处一万元以上三万元以下罚款
B. 两年内不受理其申请，并处一万元以上三万元以下罚款
C. 三年内不受理其申请，并处一万元以上三万元以下罚款
D. 四年内不受理其申请，并处一万元以上三万元以下罚款
E. 五年内不受理其申请，并处一万元以上三万元以下罚款

正确答案：E。五年内不受理其申请，并处一万元以上三万元以下罚款

解析：本题考查医疗机构制剂注册监督管理。根据《医疗机构制剂注册管理办法》，提供虚假的证明文件、申报资料、样品或者采取其他欺骗手段申请批准证明文件的，己取得批准证明文件的，撤销其批准证明文件，五年内不受理其申请，并处一万元以上三万元以下罚款（E对）。《医疗机构制剂注册管理办法（试行）》第五章监督管理第四十一条：提供虚假的证明文件、申报资料、样品或者采取其他欺骗手段申请批准证明文件的，省、自治区、直辖市（食品）药品监督管理部门对该申请不予受理，对申请人给予警告，一年内不受理其申请；已取得批准证明文件的，撤销其批准证明文件，五年内不受理其申请，并处一万元以上三万元以下罚款。